某服装厂工人的劳动强度指数经过测定为21，按照我国体力劳动强度分级方法，该工人的劳动强度属于
A. Ⅰ级
B. Ⅱ级
C. Ⅲ级
D. Ⅳ级
E. Ⅴ级

正确答案：C。Ⅲ级

解析：Ⅰ级劳动强度指数＜15；
Ⅱ级劳动强度指数～20；
Ⅲ级劳动强度指数～25；
Ⅳ级劳动强度指数＞25